关于窝沟龋的病理表现，以下叙述错误的是
A. 从病损的侧沟壁开始
B. 沿釉柱方向向深部扩展
C. 超过窝沟底部，形成口小底大的三角形
D. 病变可以进展到达牙本质
E. 表面形成明显龋洞

正确答案：E。表面形成明显龋洞

解析：本题考查牙釉质龋。关于窝沟龋的病理表现，以下叙述错误的是表面形成明显龋洞（E错，为本题正确答案）。窝沟龋损并非从底部开始，而是呈环状围绕着窝沟壁进展，并沿釉柱长轴方向向深部延伸，当病变进展超过窝沟底部时，由于窝沟附近的釉柱排列方向为向窝沟底部集中，形成的龋损及形态为口小底大的三角形潜行性龋损，由于釉质在窝沟底部较薄，窝沟龋很容易进展到牙本质。此种病变在临床检查可能无明显龋洞，但其深层已有较大范围的病变。